鉴别肾盂肾炎和下尿路感染最有意义的是
A. 尿频、尿急、尿痛
B. 高热、腰痛
C. 尿细菌培养阳性
D. 尿中白细胞管型
E. 血尿

正确答案：D。尿中白细胞管型

解析：对鉴别肾盂肾炎和下尿路感染最有意义的是尿中白细胞管型（D对），尿中白细胞管型既提示存在感染也提示了感染部位（肾脏）。尿频、尿急、尿痛（A错）为下尿路感染的突出症状，但是肾盂肾炎往往伴有尿路刺激症状。高热、腰痛（B错）提示全身性感染，严重的下尿路感染也会出现高热、腰痛，不能提示病变性质。尿细菌培养阳性（C错）只能说明存在感染，不能区别是上下尿路感染。血尿（E错）提示泌尿系炎症。